某湖水水质经治理后，有明显改善，水质指数由35上升至78。该水质指数最有可能是
A. Brown水质指数
B. I₂环境质量指数
C. 比值算术均数型指数
D. 等标污染负荷指数
E. 分段线性函数型指数

正确答案：A。Brown水质指数